男婴，3个月，腹泻2个月。大便3-4次/日，有时多达5-6次/日，稀水状或糊状，无脓血，食欲佳，精神好。生后一直母乳喂养。查体：体重5.8kg，面部湿疹，心肺腹查体正常。最可能的诊断是
A. 病毒性肠炎
B. 失氯性腹泻
C. 细菌性肠炎
D. 生理性腹泻
E. 真菌性肠炎

正确答案：D。生理性腹泻

解析：患儿3月月龄，腹泻2个月（生后不久即出现腹泻），外观虚胖，面部有湿疹，除大便次数增多外，无其他症状，食欲好，不影响生长发育。综合患儿的病史、临床表现和体征，最可能的诊断是生理性腹泻（D对）。失氯性腹泻（B错）会导致小肠消化吸收功能障碍，出现脂肪泻（P231）。真菌性肠炎（E错）患儿常伴鹅口疮，大便次数增多，黄色稀便，泡沫较多，带黏液，有时可见豆腐渣样细块（菌落）（P231）。